有关普查的叙述，不正确的是
A. 普查是现况调查的一种
B. 普查可针对一种疾病进行，也可以同时调查几种疾病
C. 普查的疾病最好是患病率比较低
D. 普查的疾病应有简单而准确的检测手段和方法

正确答案：C。普查的疾病最好是患病率比较低

解析：本题考查普查的优点缺点。普查是现况调查的一种（A对），采用普查的疾病应有简单而准确的检测手段（D对）。普查可针对一种疾病进行，也可以同时调查几种疾病（B对）。但普查不适用于患病率低的疾病（C错，为本题正确答案）。